华盖的脏器
A. 心
B. 肝
C. 肺
D. 脾
E. 肾

正确答案：C。肺

解析：本题考查的是五脏的位置。华盖的脏器肺（C对）。肺居胸腔，左右各一，上接气管、喉咙，与鼻相通。在诸脏腑中，肺位最高，故称“华盖”。心（A错）居于胸腔，横膈之上，有心包卫护于外。肝（B错）位于右胁之内，横膈之下。肝具有刚强之性，喜条达舒畅而恶抑郁；内寄相火，主升主动，易亢易逆，故称“刚脏”。脾（D错）位于中焦，横膈之下。脾为后天之本，气血生化之源。肾（E错）左右各一，位于腰部，故“腰为肾之府”。